根据英国Cochrane中心联合循证医学和临床流行病学专家共同制定的循证医学证据分级标准，“未经严格论证或评估的专家意见”在循证医学评价中的证据级别属于
A. Ⅰ级
B. Ⅱ级
C. Ⅲ级
D. Ⅴ级
E. Ⅳ级

正确答案：D。Ⅴ级

解析：本题考查循证医学的证据分级。证据级别Ⅴ级（D对）为基于经验未经严格论证的专家意见。证据级别还有：Ⅰa同质RCT的系统评价。Ⅰb单个RCT的系统评价（可信区间窄）。Ⅰc全或无病案系列。Ⅱa同质队列研究的系统评价。Ⅱb单个队列研究的系统评价。Ⅱc结果研究，生态学研究。Ⅲa同质病例对照研究的系统评价。Ⅲb单个病例对照研究的系统评价。Ⅳ病例系列研究（包括低质量队列和病例对照研究）。